下列关于肠道杆菌鞭毛抗原的叙述中，不正确的是
A. 为细菌的鞭毛蛋白
B. 鞭毛抗原就是H抗原
C. 鞭毛抗原是肠道杆菌抗原结构的一种
D. 鞭毛抗原也是K抗原或Vi抗原
E. 如失去鞭毛的细菌，H抗原消失，O抗原暴露，称为H-O变异

正确答案：D。鞭毛抗原也是K抗原或Vi抗原

解析：鞭毛抗原（H抗原）：为细菌的鞭毛蛋白，失去鞭毛的细菌，H抗原消失，O抗原暴露，称为H-O变异。掌握“肠道杆菌共性及埃希氏菌属”知识点。